缓（控）释制剂重复多次给药后，峰浓度和谷浓度之差与稳态平均血药浓度的比值称为
A. 波动度
B. 相对生物利用度
C. 绝对生物利用度
D. 脆碎度
E. 絮凝度

正确答案：A。波动度

解析：本题考查波动度的定义。缓（控）释制剂重复多次给药后，峰浓度和谷浓度之差与稳态平均血药浓度的比值称为波动度（A对）。